女，56岁。多关节痛1年，以双膝关节为首发表现，伴晨僵15分钟。查体：双手近端和远端指间关节压痛，骨性肿大，双膝关节骨摩擦音阳性。检查：血沉22mm/小时，类风湿因子15U/L（正常＜20U/L）。该患者最可能的诊断是
A. 风湿关节炎
B. 骨关节炎
C. 未分化结缔组织病
D. 强直性脊柱炎
E. 痛风

正确答案：B。骨关节炎

解析：老年女性患者（骨关节炎好发人群），出现多关节疼痛1年，以双膝关节为首发表现（负重关节，为骨关节炎好发部位），伴晨僵15分钟，双手近端和远端指间关节压痛、骨性肿大，双膝关节骨摩擦音阳性（上述均为骨关节炎常见临床表现），实验室检查：血沉加快，RF（类风湿因子）阴性，考虑患者最可能的诊断是骨关节炎（B对）。风湿性关节炎（A错）最常见于5～15岁的儿童和青少年，以膝、踝、肘、腕、肩等大关节受累为主，呈游走性、多发性关节炎。局部可有红、肿、灼热、疼痛和压痛，关节疼痛很少持续一个月以上，通常在2周内消退（P805）。未分化结缔组织病（C错）常表现为乏力、低热、淋巴结肿大等非特异性表现。强直性脊柱炎（D错）早期首发症状常为下腰背痛伴晨僵，症状在夜间休息或久坐时较重，活动后可以减轻，90%左右的患者HLA-B27阳性（P825）。痛风（E错）以单侧第1跖趾最常受累，主要表现为受累关节的红、肿、热、痛和功能障碍，发作常呈自限性，多于数天或2周内自行缓解（P861）。